创伤性溃疡治疗中，首要措施是
A. 局部使用抗生素
B. 局部封闭
C. 全身使用肾上腺发质激素
D. 尽快去除刺激因素
E. 理疗

正确答案：D。尽快去除刺激因素

解析：首先应去除局部刺激因素，如拔除残根，修改或拆除不合适的修复体，磨改锐利的牙尖或切嵴。掌握“创伤性溃疡”知识点。